风湿性心脏病严重二尖瓣狭窄突发大咯血是由于
A. 肺毛细血管破裂
B. 合并肺结核
C. 急性肺水肿
D. 支气管静脉破裂
E. 合并支气管扩张

正确答案：D。支气管静脉破裂

解析：风湿性心脏病严重二尖瓣狭窄突发大咯血是由于严重二尖瓣狭窄，左心房压力突然增高，肺静脉压增高，支气管静脉破裂（D对）出血所致。肺毛细血管破裂（A错）可导致二尖瓣狭窄患者出现痰中带血、血痰或粉红色泡沫痰。急性肺水肿（C错）一般因毛细血管破裂而咳粉红色泡沫痰。合并肺结核（B错）若出现空洞壁肺动脉分支形成的小动脉瘤破裂，或继发的结核性支气管扩张形成的动静脉瘘破裂，则可造成大量咯血，合并支气管扩张（E错）若小动脉被侵蚀或增生的血管被破坏也可引起大咯血，但临床并不常见，二尖瓣狭窄突发大咯血最直接的病理生理改变还是支气管静脉破裂。